应激时血浆浓度降低
A. HSP70
B. 白蛋白
C. 急性期反应蛋白
D. 儿茶酚胺
E. β-内啡肽

正确答案：B。白蛋白

解析：白蛋白（B对）在应激时血浆浓度降低。